男，43岁，长期咳嗽，经常咳脓痰15年，发热、咳脓臭痰1周来诊。查体：左肺下背部呼吸音弱，可闻湿啰音。治疗药物应选择下列哪项
A. 青霉素
B. 青霉素+复方甘草片
C. 丁胺卡那
D. 哌拉西林+甲硝唑
E. 丁胺卡那+甲硝唑

正确答案：D。哌拉西林+甲硝唑

解析：中年男性患者，咳嗽、咳脓痰15年（支扩的典型临床表现），近日发热、咳脓臭痰（提示有感染），查体：左肺下背部呼吸音弱，可闻湿啰音（提示左下肺炎），根据患者的病史、临床症状及体征，考虑诊断可能为支气管扩张症，继发感染，治疗药物应选择哌拉西林+甲硝唑（D对），支气管扩张急性感染时常见的病原菌是流感嗜血杆菌、铜绿假单胞菌，哌拉西林用于铜绿假单胞菌的治疗，甲硝唑用于厌氧菌的治疗。